子宫肌瘤的症状与下述何项关系密切
A. 肌瘤的大小
B. 肌瘤生长的部位（宫体、宫颈）
C. 发生年龄
D. 肌瘤与肌层的关系（粘膜下、浆膜下、壁间）
E. 肌瘤数目

正确答案：D。肌瘤与肌层的关系（粘膜下、浆膜下、壁间）

解析：症状出现与肌瘤部位(粘膜下、浆膜下、壁间)、生长速度及肌瘤变性关系密切，与肌瘤大小、数目多少关系不大。掌握“子宫肌瘤”知识点。